清洁生产是指
A. 生产场地清洁、厂房清洁
B. 生产场所清洁卫生、无垃圾灰尘
C. 清洁的生产过程
D. 节约能源、资源消耗少，有效预防控制污染和其他废物生成的生产工艺过程
E. 生产过程中有严格卫生管理制度，工人始终保持清洁卫生

正确答案：D。节约能源、资源消耗少，有效预防控制污染和其他废物生成的生产工艺过程

解析：本题考查清洁生产。清洁生产是节约能源、资源消耗少，有效预防控制污染和其他废物生成的生产工艺过程（D对ABCE错）。